为增强散瘀止痛作用，自然铜在煅烧后宜选用的炮制方法是
A. 醋淬
B. 酒淬
C. 酒蒸
D. 酒炙
E. 醋炙

正确答案：A。醋淬

解析：本题考查自然铜的炮制作用。自然铜【炮制方法】煅自然铜：取净自然铜，置耐火容器内，用武火加热，煅至红透立即取出，投入醋液中淬制，待冷后取出，继续煅烧醋淬（A对）至黑褐色，外表脆裂，光泽消失，质地酥脆，取出，摊开放凉，干燥后碾碎。【炮制作用】自然铜味辛，性平。归肝经。具有散瘀、接骨、止痛的功能。本品多煅制用，经煅淬后，可增强散瘀止痛作用。酒多用作炙（D错）、蒸（C错）、煮的辅料，常用酒制的药物有黄芩、黄连、大黄、白芍、续断、当归、丹参、川芎、金钱白花蛇、乌梢蛇等。艾叶【炮制作用】醋炙（E错）艾叶炭，温经止血的作用增强。用于虚寒性出血。艾叶经加热炮制后，挥发油含量大幅度降低，且随温度的升高、时间的延长呈逐渐降低的趋势。说明炮制对艾叶的挥发油成分有显著影响。